青光眼病人的眼压约在22～42mmHg范围，非青光眼病人的眼压约在14～26mmHg范围内，根据这些资料，可以认为：如果将筛检标准值定为22mmHg，可以认为灵敏度与特异度的关系为
A. 灵敏度较好，特异度也较好
B. 灵敏度较差，特异度也较差
C. 灵敏度较好，特异度较差
D. 灵敏度较差，特异度较好
E. 无法判断

正确答案：C。灵敏度较好，特异度较差

解析：本题考查确定连续性测量指标的阳性截断值。青光眼病人的眼压约在22～42mmHg范围，非青光眼病人的眼压约在14～26mmHg范围内，如果将筛检标准值定为22mmHg，可以较好的把病人筛检出来，但不能把非病人筛检出来，即灵敏度较好，特异度较差（C对ABDE错）。